若方程（hat）Y=a+bx中的截距a＜0，说明
A. 随着x的增大，y增大
B. 随着x的增大，y减少
C. 随着x的减少，y减少
D. 回归直线与y轴的交点在原点下方
E. 回归直线与y轴的交点在原点上方

正确答案：D。回归直线与y轴的交点在原点下方